男性，30岁，从三楼跌下左腹部跌伤，左6、7、8肋骨骨折，脾破裂肠破裂。入院时精神紧张，T38.5℃，面色苍白，肢端冰冷，脉搏细速，P110次/分，血压130/100mmHg，尿量减少。该病人的休克状态应属于
A. 休克前期
B. 中度休克
C. 重度休克
D. 暖休克
E. 冷休克

正确答案：A。休克前期

解析：患者外伤脾破裂后出现精神紧张、面色苍白、脉搏肢端冰冷、脉搏细速、尿量减少等症状，提示出现失血性休克。其脉搏110次/分，血压130/100mmHg，说明该病人的休克状态应属于休克前期（即休克代偿期）（A对）。需注意：若以脉搏次数、收缩压对休克分度诊断矛盾时，应以收缩压为准。中度休克（B错）血压的收缩压降至90～70mmHg；重度休克（C错）的收缩压在70mmHg以下或测不到；暖休克（D错）与冷休克（E错）属于感染性休克的分类标准。